既补中益气，又生津养血的药是
A. 黄芪
B. 甘草
C. 党参
D. 大枣
E. 当归

正确答案：C。党参

解析：本题考查的是党参的功效。既补中益气，又生津养血的药是党参（C对）。党参：【功效】补中益气，生津养血。黄芪（A错）：【功效】补气升阳，益卫固表，托毒生肌，利水消肿。甘草（B错）：【功效】益气补中，祛痰止咳，解毒，缓急止痛，缓和药性。大枣（D错）：【功效】补中益气，养血安神，缓和药性。当归（E错）：【功效】补血活血，调经止痛，润肠通便。